特定时间内，总人口中现患某病者所占的比例
A. 患病率
B. 病死率
C. 续发率
D. 死亡率
E. 感染率

正确答案：A。患病率

解析：患病率指某特定时间内，总人口中现患某病者（包括新、旧病例）所占的比例。患病率的分子包括调查期间被观察人群中所有的病例，分母为被观察人群的总人口数或该人群的平均人口数。掌握“流行病学资料与疾病分布”知识点。